属于促凝血因子活性药的是
A. 酚磺乙胺
B. 氨甲环酸
C. 血凝酶
D. 卡巴克洛
E. 维生素K₁

正确答案：A。酚磺乙胺

解析：本题考查属于促凝血因子活性药。酚磺乙胺（A对）为促凝血因子活性药。氨甲环酸（B错）为氨基酸类抗纤溶酶药。血凝酶（C错）能促进血管破损部位的血小板聚集。卡巴克洛（D错）为影响血管通透性药。维生素K₁（E错）为促凝血因子合成药。